肝在体为
A. 皮
B. 脉
C. 肉
D. 筋
E. 骨

正确答案：D。筋

解析：肝在体合筋（D对），其华在爪。筋，附着于骨而聚于关节，具有连接关节、肌肉，主司关节运动的功能。筋依赖于肝血和肝气的濡养。肝血充足，筋得其养，运动灵活而有力。若肝血亏虚，筋脉失养，则运动能力减退；肺在体合皮，其华在毛（A错）；心在体合脉，其华在面（B错）；脾在体合肉，主四肢（C错）；肾在体合骨，荣齿，其华在发（E错）。